《医疗用毒性药品管理办法》规定，医疗单位调配毒性药品，每次处方剂量不得超过
A. 2日剂量
B. 3日剂量
C. 2日极量
D. 3日极量
E. 4日剂量

正确答案：C。2日极量

解析：本题考查处方限量。医疗单位调配毒性药品，每次处方剂量不得超过二日极量（C对）。医疗机构供应和调配毒性药品，须凭执业医师签名的正式处方。具有毒性药品经营资格的零售药店，供应和调配毒性药品时，须凭盖有执业医师所在的医疗机构公章的正式处方。每次处方剂量不得超过二日极量。